世界卫生组织将口腔鳞癌分级的标准是
A. 恶性程度
B. 细胞的多形性
C. 细胞核的多形性
D. 细胞分裂活性
E. 以上均包括

正确答案：E。以上均包括

解析：本题考查口腔黏膜癌。世界卫生组织将口腔鳞癌分级的标准是恶性程度（A对）、细胞的多形性（B对）、细胞核的多形性（C对）、细胞分裂活性（D对）。综上，选E。根据肿瘤的恶性程度、细胞和细胞核的多形性以及细胞分裂活性等将鳞状细胞癌分为高、中、低分化三级：高分化鳞状细胞癌与正常鳞状上皮颇类似，即含有数量不等的基底细胞和具有细胞间桥的鳞状细胞，角化明显，核分裂象少，非典型核分裂和多核细胞极少，胞核和细胞多形性不明显；中度分化鳞状细胞癌具有独特的核的多形性和核分裂，包括非正常核分裂，角化不常见，细胞间桥不显著；低分化鳞癌以不成熟的细胞为主，有大量的正常或不正常的核分裂，角化非常少，细胞间桥几乎不能发现。